可选作水溶性颗粒剂辅料的有
A. 甘露醇
B. 糖粉
C. 处方中部分药材细粉
D. 乳糖
E. 可溶性糊精

正确答案：A、B、D、E。甘露醇；糖粉；乳糖；可溶性糊精